关于不可复性关节盘移位临床特点的叙述，哪项是错误的
A. 开口时下颌偏向健侧
B. 典型的关节弹响病史
C. X线片显示关节前间隙增宽
D. 被动开口检查，开口度不能增大
E. 间断性关节绞锁史

正确答案：A。开口时下颌偏向健侧

解析：不可复性关节盘移位：有典型的关节弹响病史，继之有间断性关节绞锁史，进而弹响消失，开口受限。临床检查开口受限，开口时下颌偏向患侧，关节区疼痛；被动开口检查，开口度不能增大。X线片（许勒位）可见关节后间隙变窄，关节造影片或MRI检查可证实关节盘前移位。掌握“颞下颌关节紊乱”知识点。